心理治疗和心理咨询本质上是相同的，但也有下列差别，应除外
A. 工作任务不同
B. 工作时间长短不同
C. 对象和情境不同
D. 身份和工作方式不同
E. 解决问题的性质和内容不同

正确答案：B。工作时间长短不同